通过颊间隙的重要组织结构不包括
A. 面神经分支
B. 颌外动脉
C. 颌内动脉
D. 腮腺导管
E. 面前静脉

正确答案：C。颌内动脉

解析：本题考查通过颊间隙的重要组织结构。上颌动脉，或称颌内动脉（C错，为本题的正确答案），位于面侧深区，于下颌骨髁突颈部的内后方起于颈外动脉，经髁突颈的深面前行至颞下窝，通常在翼外肌的浅面或在深面，行向前上，经翼上颌裂进入翼腭窝，经过颞下间隙。广义的颊间隙是指位于颊部皮肤与颊黏膜之间颊肌周围的间隙，其上界为颧骨下缘；下界为下颌骨下缘；前界从颧骨下缘至鼻唇沟经口角至下颌骨下缘的连线；后界浅面相当于咬肌前缘；深面为翼下颌韧带。间隙内有蜂窝组织、脂肪组织、颊脂垫，面神经分支（A对）、腮腺导管（D对）、面动脉（颌外动脉）（B对）、面静脉（面前静脉）（E对）通过，以及颊淋巴结、颌上淋巴结等。